下颌下腺管和舌下腺大管共同开口在
A. 舌系带
B. 舌下襞
C. 舌下阜
D. 伞襞
E. 以上均不是

正确答案：C。舌下阜

解析：下颌下管和舌下腺大管都开口于舌系带根部两侧的舌下阜(C对)上。